不能用于特别不合作儿童的药物是
A. 2％氟化钠
B. 8％氟化亚锡
C. 酸性氟磷酸钠
D. 38％氟化氨银
E. 10％氟化钼酸铵

正确答案：D。38％氟化氨银

解析：本题考查乳牙龋病的药物治疗。氟化氨银（D错，为本题的正确答案）的缺点是对软组织有腐蚀作用，不合作的儿童使用氟化氨银时易造成软组织损伤，故不能用于特别不合作儿童。乳牙龋病治疗常用药物有：2％氟化钠溶液（A对）、8％氟化亚锡溶液（B对）、1.23％酸性氟磷酸钠溶液（C对）、38％氟化氨银溶液、10％氟化钼酸铵溶液（E对）等。